未经医师注册取得执业证书的
A. 不得从事医师执业活动
B. 可在预防机构从事医师执业活动
C. 可在保健机构从事医师执业活动
D. 可在执业医师指导下，在预防、保健机构，从事医师执业活动
E. 可在执业医师指导下从事医师执业活动

正确答案：A。不得从事医师执业活动

解析：医师执业条件：医师经注册后，可以在医疗、预防、保健机构中按照注册的执业地点、执业类别、执业范围执业，从事相应的医疗、预防、保健业务。未经医师注册取得执业证书，不得从事医师执业活动。掌握“执医概述及考试和注册”知识点。